下列经脉循行除哪项外，都经过心
A. 手厥阴经
B. 手少阴经
C. 手太阳经
D. 手阳明经
E. 足少阴经

正确答案：D。手阳明经

解析：该题考查十二经脉的循行，对于一些经脉的支部循行尤应注意。手阳明大肠经起于食指桡侧端，循行于上肢外侧的前缘，上走肩，入缺盆，络肺属大肠；从缺盆上走颈，经颈部入下齿，过人中沟，止于对侧鼻旁，不经过心，故（D对）。